对一级亲属有糖尿病的人群进行血糖筛查，尽量早期发现糖尿病属于
A. 一级预防
B. 二级预防
C. 三级预防
D. 个体治疗
E. 社区综合防治

正确答案：B。二级预防